某女，51岁。经断前后，腰膝酸软，偶有烘热汗出，神疲乏力，畏寒肢冷；舌淡胖嫩，苔薄白，脉沉细无力。诊断为绝经前后诸证，证属脾肾阳虚，宜选用的中成药是
A. 坤宝丸
B. 更年安片
C. 龙凤宝胶囊
D. 更年宁心胶囊
E. 灵莲花颗粒

正确答案：C。龙凤宝胶囊

解析：本题考查绝经前后诸证之脾肾阳虚证的中成药应用。诊断为绝经前后诸证，证属脾肾阳虚，宜选用的中成药是龙凤宝胶囊（C对）。绝经前后诸证之脾肾阳虚证【症状】经断前后，腰脊冷痛，肢软无力，神疲体倦，或浮肿便溏，或纳差腹胀，或带下量多，色白清稀，甚者畏寒肢冷，面色㿠白。舌淡嫩，苔白润，脉细弱无力。【中成药应用】常用中成药为龙凤宝胶囊。绝经前后诸证之肝郁肾虚证【症状】经断前后，阵发性烘热汗出，腰膝酸软，烦躁易怒，情绪异常，头晕耳鸣，乳房胀痛，月经紊乱，或胸闷善太息。舌淡红或偏暗，苔薄白，脉弦细。【中成药应用】常用中成药为女珍颗粒、坤宝丸（A错）。绝经前后诸证之阴虚火旺证【症状】绝经前后，月经紊乱，心烦易怒，懊恼不安，坐卧不宁，哭笑无常，夜卧多梦善惊，口干渴饮，尿黄便燥。舌质红，苔薄黄，脉弦细而数。【中成药应用】常用中成药为更年安片（B错）、更年宁心胶囊（D错）、灵莲花颗粒（E错）。